乳腺癌最多见于的部位是乳腺的
A. 内上象限
B. 内下象限
C. 外下象限
D. 外上象限
E. 中央区

正确答案：D。外上象限